某心理咨询师，在超级市场遇见一位他的患者也正与其熟人在一起购物，这位治疗师故意未理睬他的患者，因为他遵循的一个心理治疗的原则是
A. 真诚原则
B. 保密原则
C. 中立原则
D. 回避原则
E. 灵活原则

正确答案：B。保密原则

解析：心理治疗的基本原则有信赖性原则、整体性原则、发展性原则、个性化原则、中立性原则、保密性原则。保密性原则是心理治疗的原则之一，它要求治疗者尊重患者的权利和隐私。由于心理治疗的特殊性和患者对治疗者的高度信任，他们常常把自己从不被人知道的隐私暴露出来，这些隐私可能涉及到个人在社会中的名誉和前途，或牵扯到与其他人的矛盾和冲突，若得不到保护和尊重，会造成恶劣影响。题中心理咨询师故意未理睬他的患者是希望保护患者接受心理治疗的隐私，遵循的是保密原则（B对）。中立性原则要求治疗者在心理治疗过程中保持中立的态度和立场（C错）。真诚原则（A错）、回避原则（D错）、灵活原则（E错）均不是心理治疗的原则。